女，30岁。白带增多伴腥臭味1个月，妇科检查见阴道分泌物呈稀薄灰白色。镜检发现线索细胞，考虑诊断
A. 滴虫阴道炎
B. 念珠菌阴道炎
C. 细菌性阴道病
D. 支原体性阴道炎
E. 衣原体性阴道炎

正确答案：C。细菌性阴道病

解析：该患者，白带增多伴腥臭味（有症状者主要表现为阴道分泌物增多，有鱼腥臭味）。妇检见阴道分泌物呈稀薄灰白色，镜检发现线索细胞（符合Amsel临床诊断标准的前两条），故考虑诊断为细菌性阴道病（C对）。滴虫阴道炎分泌物特征为稀薄脓性、黄绿色、泡沫状、有臭味。念珠菌阴道炎（P249）（B错）即假丝酵母菌病，分泌物特征为白色稠厚呈凝乳或豆腐渣样。支原体性阴道炎（D错）和衣原体性阴道炎（E错）较少见，阴道分泌物呈黏液脓性。